位于头部，当眉梢与目外眦之间，向后约一横指的凹陷处的腧穴是
A. 哑门
B. 太阳
C. 定喘
D. 腰痛点
E. 夹脊穴

正确答案：B。太阳

解析：太阳在头部，当眉梢与目外眦之间，向后约一横指的凹陷中（B对）。哑门在颈后区，第2椎棘突上际凹陷中，后正中线上（A错）。定喘在脊柱区，横平第7颈椎棘突下，后正中线旁开0.5寸（C错）。腰痛点在手背，第2、3掌骨及第4、5掌骨之间，腕背侧横纹远端与掌指关节中点处，一手2穴（D错）。夹脊穴在背腰部，从第一胸椎至第五腰椎棘突下两侧，后正中线旁开0.5寸，一侧17个穴位，乃华佗所创（E错）。